休克病人治疗过程中中心静脉压为20cmH₂0，血压120/80mmHg，处理原则为
A. 适当补液
B. 收缩血管
C. 舒张血管
D. 补液试验
E. 充分补液

正确答案：C。舒张血管

解析：根据表5-2 中心静脉压与补液的关系（P37）可知中心静脉压高（中心静脉压正常值为5～10cmH₂O）、血压正常提示容量血管过度收缩，应舒张血管（C对）。适当补液（A错）为中心静脉压低、血压正常时的处理原则。充分补液（D错）为中心静脉压、血压均低时的处理原则。补液试验（E错）为中心静脉压正常、血压降低时的处理原则，可区分血容量不足与心功能不全。收缩血管（B错）为充分容量复苏后的处理措施，可维持脏器灌注压。